在进食鱼、虾、蟹、蛋、奶等后可发生过敏性胃肠炎的反应是
A. 皮肤过敏反应
B. 消化道过敏反应
C. 呼吸道过敏反应
D. 药物过敏性休克
E. 血清病

正确答案：B。消化道过敏反应

解析：消化道过敏反应：过敏体质的个体在进食鱼、虾、蟹、蛋、奶等后可发生过敏性胃肠炎，表现为恶心、呕吐、腹痛及腹泻等，严重者可发生过敏性休克。掌握“概述及Ⅰ型超敏反应”知识点。